医疗保障体系的构建中，发挥托底作用的是
A. 基本医疗保险
B. 补充医疗保险
C. 商业健康保险
D. 医疗救助

正确答案：D。医疗救助

解析：本题考查医疗救助的概念。医疗救助（D对）是帮助困难群众获得基本医疗保险服务并减轻其医疗费用负担的制度安排。国家整合完善城乡医疗救助，不断加大财政投入力度，提高托底保障能力，制度受益人群逐步扩展，确保困难群众公平获得基本医疗服务。基本医疗保险（A错）覆盖城乡全体就业和非就业人口，公平普惠保障人民群众基本医疗需求。补充医疗保险（B错）保障参保群众基本医疗保险之外个人负担的符合社会保险相关规定的医疗费用。鼓励商业健康保险（C错）发展鼓励产品创新，完善支持政策，加强市场行为监督管理，突出商业健康保险产品设计、销售、赔付等关键环节监管。